脂水分配系数高的化学物
A. 易溶于水，易于吸收，易随尿排出
B. 易溶于水，难于吸收，易随尿排出
C. 易溶于水，难于吸收，难随尿排出
D. 难溶于水，易于吸收，难随尿排出
E. 难溶于水，难于吸收，易随尿排出

正确答案：D。难溶于水，易于吸收，难随尿排出